太溪在五输穴中属
A. 井穴
B. 荥穴
C. 合穴
D. 经穴
E. 输穴

正确答案：E。输穴

解析：太溪是肾经的输穴（E对）、原穴。足少阴肾经井穴（A错）是涌泉，荥穴（B错）是然谷，经穴（D错）是复溜，合穴（C错）是阴谷。